衡量某病和某暴露因素间联系强度的最佳指标是
A. 暴露者的发病率
B. 暴露者的死亡率
C. 暴露者的致残率
D. 相对危险度
E. 特异危险度

正确答案：D。相对危险度

解析：在队列研究中，相对危险度（D对）是衡量某病和某暴露因素间联系强度最有用的指标。特异危险度（E错）是暴露组发病率与非暴露组发病率的差值，反映的是暴露因素对发病率的影响。暴露者的发病率（A错）表示暴露组中暴露因素造成某种疾病的发病率：暴露者的死亡率（B错）表示暴露组中暴露因素造成的死亡率：暴露者的致残率（C错）表示暴露组中暴露因素对暴露者造成伤残者所占暴露组样本术的比率。这三者都可表示某暴露因素对暴露者的效应，因为没有参考非暴露组的数据，因此不是衡量某病和某暴露因素间联系强度的最佳指标。